阿托品引起心悸、瞳孔扩大、视近物模糊的剂量
A. 0.5mg
B. 1mg
C. 2mg
D. 5mg
E. 10mg

正确答案：C。2mg

解析：2mg：心悸，明显口干，瞳孔扩大，视近物模糊。掌握“阿托品”知识点。